女，35岁。心悸、消瘦6个月，高热腹泻、谵语1天。查体：T40.2℃，BP90/60mmHg，大汗，甲状腺IⅡ度肿大，可闻及血管杂音，双肺未闻及干湿性啰音，心率200次/分，心律绝对不齐。应首先考虑的诊断是
A. 甲状腺危象
B. 感染性休克
C. 甲状腺功能亢进症合并肠炎
D. 甲亢性心脏病
E. 急性甲状腺炎

正确答案：A。甲状腺危象

解析：青年女性患者，心悸、消瘦6个月（高代谢的症状和体征），高热腹泻、谵语1天（甲状腺危象的典型临床表现），查体：T40.2℃（正常值为36℃～37℃），BP90/60mmHg（90～140/60～90mm/Hg），大汗，甲状腺Ⅲ度肿大，可闻及血管杂音（甲亢的典型体征），双肺未闻及干湿性啰音，心率200次/分（正常值为60～90次/分，心动过速），心律绝对不齐，根据该患者的临床表现、症状及体征，该患者最可能的诊断是甲状腺危象（A对），甲状腺危象是甲状腺毒症急性加重的一个综合征，发生原因与甲状腺激素大量进入循环有关。多发生于较重甲亢未予治疗或治疗不充分的病人，临床表现有：高热或过高热，大汗，心动过速（>140次/分），烦躁，焦虑不安，谵妄，恶心，呕吐，腹泻，严重病人可有心衰、休克及昏迷等。本例患者优先考虑甲状腺危象，是否患有肠炎要进行消化系统相关检查才能确认或排除（C错）。感染性休克（B错）是外科常见并且治疗较为困难的一类休克，是机体对宿主-微生物应答失衡的表现。常继发于革兰阴性杆菌为主的感染，如急性腹膜炎、胆道感染、绞窄性肠梗阻及泌尿系感染等，也称为内毒素性休克，是全身炎症反应综合征、细菌感染及休克三者的综合表现。甲亢性心脏病（D错）多发生于老年患者，主要表现为心动过速、心排出量增加、心房颤动和心力衰竭。急性甲状腺炎（E错）主要表现为甲状腺不同程度肿大，质地较硬并伴有不同程度的疼痛。